下列具有疏风散邪，清热解毒功用的方剂是
A. 黄连解毒汤
B. 普济消毒饮
C. 清瘟败毒饮
D. 青蒿鳖甲汤
E. 龙胆泻肝汤

正确答案：B。普济消毒饮

解析：本题考查方剂的功用，属于记忆内容。普济消毒饮主治大头瘟，大头瘟是感受风热疫毒，发于头面所致。普济消毒饮功用清热解毒，疏风散邪（B对）。黄连解毒汤功用泻火解毒（A错）。清瘟败毒饮功用清热解毒，凉血泻火（C错）。青蒿鳖甲汤功用养阴透热（D错）。龙胆泻肝汤功用清泻肝胆实火，清利肝经湿热（E错）。